牙周细菌导致牙周破坏的发生，其机制为
A. 细菌直接侵袭到牙周组织中
B. 细菌直接侵害牙周组织，引起免疫反应
C. 细菌在体内繁殖
D. 抑制和躲避宿主的防御功能
E. 以上都是

正确答案：E。以上都是

解析：本题考查牙周微生物的致病机制。牙周细菌导致牙周破坏的发生，其机制有细菌直接损害宿主牙周组织（A对）它的抗原成分、各种酶、毒素及代谢产物可进入，直接破坏牙周组织，或引起牙周组织局部的免疫和炎症反应，造成组织损伤，引发宿主免疫反应（B对）。细菌能选择性地粘附、定植于宿主的适当部位，并在营养环境中生长繁殖（C对），才能引起宿主组织破坏。致病菌的生长繁殖除了需要营养环境以外，它们还必须能逃避宿主抑制和躲避宿主的防御功能（D对），主要逃避宿主的非特异性免疫功能，特别是吞噬细胞，唾液和龈沟液中含多种杀菌因子。（ABCD均对，故E为本题的正确答案）。